久病累及脾肾，以致脾肾阳虚，温煦气化失司，可以形成
A. 风气内动
B. 寒从中生
C. 湿浊内生
D. 津伤化燥
E. 火热内生

正确答案：B。寒从中生

解析：肾为先天之本，肾阳为一身阳气之根，能温煦全身脏腑形体；脾为后天之本，为气血生化之源，脾阳能达于肌肉四肢，故脾肾阳气虚弱，温煦失职，最易内生虚寒之象，“寒从中生”又称“内寒”，指机体阳气虚衰，温煦气化功能减退，虚寒内生，或阴寒之邪弥漫的病理状态（B对）。风气内动的病机主要是肝阳化风、热极生风、阴虚风动、血虚生风，不是脾肾阳虚引起的（A错）。湿浊内生是由于脾的运化功能和输布津液的功能障碍，从而引起湿浊蓄积停滞的病理状态，不是脾肾阳虚引起的（C错）。津伤化燥是由久病伤阴耗液，或大汗、大吐、大下，或亡血失精导致阴亏津少，以及某些热性病过程中的热盛伤阴耗津等所致，不是脾肾阳虚引起的（D错）。火热内生是由于阳盛有余，或阴虚阳亢，或由于气血郁滞，或由于病邪郁结而产生的火热内扰，机能亢奋的病理状态，不是脾肾阳虚引起的（E错）。